检査发现患者胸廓扁平，前后径常不到横径的一半，应考虑为
A. 鸡胸
B. 漏斗胸
C. 桶状胸
D. 扁平胸
E. 正常胸廓

正确答案：D。扁平胸

解析：检査发现患者胸廓扁平，前后径常不到横径的一半，应考虑为扁平胸（D对）。扁平胸多见于瘦长体型者，亦可见于慢性消耗性疾病，如肺结核等。鸡胸（A错）的特点是胸廓的前后径略长于左右径，其上下距离较短，胸骨下端常前突，胸廓前侧壁肋骨凹陷。漏斗胸（B错）的特点是胸骨剑突处显著内陷，形似漏斗。桶状胸（C错）的特点是胸廓前后径增加，有时与左右径几乎相等，甚至或超过左右径，故呈圆桶状。正常胸廓（E错）的特点为两侧大致对称，呈椭圆形，胸廓的前后径较左右径短，两者的比例约为1：1.5。